属于良性肿瘤的是
A. 神经鞘瘤
B. 精原细胞瘤
C. 唾液腺混合瘤
D. 霍奇金淋巴瘤
E. Paget病

正确答案：A。神经鞘瘤

解析：神经鞘瘤（A对）是起源于神经鞘细胞的良性肿瘤。精原细胞瘤（B错）和霍奇金（淋巴）瘤（D错）虽然称为“瘤”，但均为恶性肿瘤。Paget病（P303）（E错）是乳腺非浸润性癌中导管内原位癌的一种类型，属于恶性肿瘤。唾液腺混合瘤（C错）即涎腺混合瘤，是指良性和恶性两种成分并存的一类混合瘤（临床肿瘤学第四版P170）。